一般优势半球指的是下列哪项特征占优势的一侧半球
A. 重量
B. 运动功能
C. 感觉功能
D. 语言活动功能
E. 皮层沟回数

正确答案：D。语言活动功能